患者张某，中医诊断为痹证。症见：肢体关节疼痛，痛势较剧，部位固定，遇寒则痛甚，得热则痛缓，关节屈伸不利，局部皮肤或有寒冷感，舌质淡，舌苔薄白，脉弦紧。治疗方剂宜选用
A. 防风汤
B. 乌头汤
C. 薏苡仁汤
D. 双合汤
E. 以上均非

正确答案：B。乌头汤

解析：题中患者诊断为痹证，遇寒则痛甚，得热则痛缓，局部皮肤或有寒冷感，为痛痹的表现，是寒邪兼夹风湿，留滞经脉，闭阻气血所致，治宜散寒通络，祛风除湿，方用乌头汤（B对）。防风汤为行痹代表方（A错）。薏苡仁汤为着痹代表方（C错）。双合汤为痰瘀痹阻证之风湿热痹代表方（D错）。